Ⅰ型呼吸衰竭常见的原因
A. 肺泡通气不足
B. 弥散功能障碍
C. 通气血流比例失衡
D. 肺结核
E. 神经肌病

正确答案：B。弥散功能障碍

解析：Ⅰ型呼吸衰竭是指低氧性呼吸衰竭，体内主要是低氧血症，不伴有高碳酸血症，主要见于肺换气功能障碍，包括通气/血流比例失调（C对）、弥散功能损害（B对）、肺动-静脉分流等，由此可见，BC均正确。故此题不严谨。肺泡通气不足（A错）、神经肌病（E错）会造成肺通气功能障碍，导致Ⅱ型呼吸衰竭。肺结核（D错）主要临床表现为低热盗汗等结核中毒症状，很少导致呼吸衰竭，故不是Ⅰ型呼吸衰竭常见的原因。